药物出现不良反应的主要原因是
A. 药物代谢率低
B. 药物的选择性低
C. 药物剂量过大
D. 药物吸收不良
E. 病人对药物高敏感

正确答案：B。药物的选择性低